常用的康复疗法有
A. 药物康复法
B. 针灸康复法
C. 体育康复法
D. 自然康复法
E. 气功康复法

正确答案：A、B、C、D、E。药物康复法；针灸康复法；体育康复法；自然康复法；气功康复法

解析：本题考查的是常用康复疗法。常用的康复疗法有药物康复法（A对）、针灸康复法（B对）、体育康复法（C对）、自然康复法（D对）与气功康复法（E对）。常用的康复疗法：1.药物康复和康复器械辅助疗法；2.针灸推拿气功康复法；3.体育娱乐康复法；4.自然康复法。